下列物质中，对霉菌和酵母菌具有较好控制力的是
A. 对羟基苯甲酸乙酯
B. 苯甲酸钠
C. 苯扎溴铵
D. 山梨酸
E. 桂皮油

正确答案：D。山梨酸

解析：本题考查液体制剂常用的附加剂。山梨酸（D对）对霉菌和酵母菌具有较好的控制力；对羟基苯甲酸酯类（A错）对大肠埃希菌抑制作用强；苯甲酸与苯甲酸钠（B错）抗菌有效性依赖于pH值，介质酸度增高，其杀菌、抑菌效力增强，在碱性介质中则失去杀菌、抑菌作用；苯扎溴铵（C错）为阳离子型表面活性剂，多外用；其它防腐剂包括乙醇、苯酚、甲酸、桂皮油（E错）、薄荷油等。